鉴别维生素C依据的反应是
A. 芳香第一胺的反应
B. 丙二酰脲的反应
C. 绿奎宁反应
D. 托烷生物碱的反应
E. 与二氯靛酚钠的反应

正确答案：E。与二氯靛酚钠的反应

解析：本题考查常用的药品鉴别方法。鉴别维生素C依据的反应是与二氯靛酚钠的反应（E对）。维生素C可使二氯靛酚钠褪色，可用于维生素C的鉴别。芳香第一胺反应（A错）用于含芳伯氨基或潜在的芳伯氨基化合物的鉴别。丙二酰脲反应（B错）用于巴比妥类药物的鉴别。绿奎宁反应（C错）系含氧喹啉（喹啉环上含氧）衍生物的特征反应，硫酸奎宁和硫酸奎尼丁都显绿奎宁反应,在药物微酸性水溶液中,滴加微过量的溴水或氯水,再加入过量的氨水溶液,即显翠绿色。托烷生物碱反应（D错）又称Vitali反应，系托烷生物碱的特征反应。